组织液与血浆成分的主要区别在于
A. Na⁺
B. K⁺
C. Cl⁻
D. 蛋白质
E. 无机酸

正确答案：D。蛋白质